患者，男，52岁，身高168cm，体重85kg，痛风病史6年。近日因多饮、多尿就诊，实验室检查：空腹血糖7.8mmol/L（正常值：3.9～6.1mmol/L），餐后血糖148mmol/L（正常值：<7.8mmol），血尿酸580㎛ol/L（正常值：男性180～440mol/1），血LDL-C3.7mmol/L（正常值：2.1～3.lmmol/L），肌酐清除率100ml/min。颈动脉彩超提示：动脉粥样硬化，有混合性脂质斑块。临床诊断2型糖尿病、痛风、高脂血症、动脉粥样硬化症。对该患者的治疗方案，不推荐的是
A. 低嘌呤饮食
B. 应用阿司匹林
C. 适量运动
D. 控制体重
E. 应用他汀类药物

正确答案：B。应用阿司匹林

解析：本题考查其他常用血生化检查。对该患者的治疗方案，不推荐的是应用阿司匹林（B错，为本题正确答案）。阿司匹林可引起血尿酸水平升高，高尿酸患者不宜使用。痛风患者需避免摄入高嘌呤（A对）食物（如动物内脏、海鲜、肉汤、干豌豆等）；每日饮水2000～3000ml；戒烟限酒；加强锻炼（C对），控制体重（D对）；增加碱性食物的摄入。他汀类药物（E对）可引起氨基转氨酶升高，肌肉疼痛，不会引起血尿酸升高。